判断病因的标准不包括
A. 关联的时间顺序
B. 关联的强度
C. 关联的可重复性
D. 关联的合理性
E. 关联的复杂性

正确答案：E。关联的复杂性

解析：本题考查病因推断的依据。希尔病因推断的9条标准包括：①时间顺序（A对）；②关联强度（B对）；③剂量-反应关系；④结果的一致性；⑤实验证据；⑥生物学合理性（D对）；⑦生物学一致性，也叫可重复性（C对）；⑧特异性；⑨相似性。关联的复杂性（E错，为本题正确答案）并不是病因推断的标准。